女，43岁，右下腹持续性疼痛5天，伴恶心呕吐，呕出物为胃内容物。体温38.5℃。体检发现右下腹5cm×5cm大小肿块，触痛明显，最可能的诊断是
A. 粪块所致肠梗阻
B. 盲肠肿瘤
C. 急性化脓性阑尾炎
D. 阑尾周围脓肿
E. 盲肠扭转

正确答案：D。阑尾周围脓肿

解析：青年女性患者，右下腹持续疼痛（提示病变位于右下腹），伴恶心、呕吐，体温38.5℃（正常为36～37℃），体检发现右下腹有一包块，触痛明显，结合患者病史和体查，最可能的诊断为阑尾周围脓肿（D对）。粪块所致肠梗阻（A错）多见于有便秘的中老年人，表现为腹痛、腹胀、恶心、呕吐、停止自肛门排气排便，查体可触及腹部肿块，一般无触痛。盲肠肿瘤（B错）多见于中老年人，以低热、乏力、贫血、腹部肿块等为主要表现，腹痛多不明显，恶心、呕吐等肠梗阻症状出现较晚。急性化脓性阑尾炎（C错）主要表现为转移性右下腹疼痛，右下腹压痛、反跳痛和腹肌紧张明显，无腹部肿块。盲肠扭转（E错）（七版黄家驷外科学P1496）较少见，多发生在盲肠可移动的病人，可分为急性和亚急性两型，急性者起病急，有剧痛及呕吐，右下腹有肿块可触及；亚急性主要表现为右下腹绞痛，腹部呈不对称性隆起，上腹部可触及一弹性包块。